甘草次酸的两种结构类型是
A. 5-αH型和5-βH型
B. 10-αCH3型和10-βCH3型
C. 18-αH型和18-βH型
D. 8-αCH3型和8-βCH3型
E. 9-αH型和9-βH型

正确答案：C。18-αH型和18-βH型

解析：本题考查的是甘草次酸的结构类型。甘草次酸的两种结构类型是18-αH型和18-βH型（C对）。甘草所含的三萜皂苷以甘草皂苷含量最高。甘草皂苷又称甘草酸，为甘草中的甜味成分。《中国药典》以甘草苷和甘草酸为指标成分，控制甘草和炙甘草的质量，其中甘草苷为黄酮苷，并要求甘草和炙甘草的甘草苷含量均不得少于0.50%，甘草中甘草酸的含量不得少于2.0%，炙甘草中甘草酸的含量不得少于1.0%。甘草次酸可分为18-αH型和18-βH型。